Th1的主要功能是
A. 是迟发型超敏反应中的效应细胞
B. 通过分泌IL-2、IFN-γ增强NK细胞的杀伤活性
C. 通过分泌IFN-γ促进IgG的生成从而促进调理吞噬作用
D. 分泌IL-2、IFN-γ刺激CTL细胞的增殖和分化，促进CTL对肿瘤和病毒感染细胞的杀伤
E. 以上说法均正确

正确答案：E。以上说法均正确

解析：Th1的主要功能是：①通过分泌IL-2、IFN-γ刺激CTL细胞的增殖和分化，促进CTL对肿瘤和病毒感染细胞的杀伤；②通过分泌IFN-γ增强吞噬细胞的吞噬和杀伤，尤其是杀伤胞内寄生菌的功能；③通过分泌IFN-γ促进IgG的生成从而促进调理吞噬作用；④是迟发型超敏反应中的效应细胞；⑤通过分泌IL-2、IFN-γ增强NK细胞的杀伤活性。掌握“T淋巴细胞”知识点。